小儿腹泻时口服补液盐（ORS液）的电解质渗透压是含钠液的
A. 1/4张
B. 1/3张
C. 2/5张
D. 1/2张
E. 2/3张

正确答案：E。2/3张

解析：NaCl2.6g+枸橼酸钠2.9g+KCl1.5g+无水葡萄糖13.5g，加水至1000ml。总渗透压245mOsm/L，为2/3张（E对）。